女孩，2岁。腹泻伴呕吐3天，大便7～8次/日，为黄绿色稀水样便，黏液较多，时有发热、腹痛。粪常规示白细胞（++）。不宜采用的治疗是
A. 液体疗法
B. 锌制剂
C. 止泻剂
D. 肠道微生态制剂
E. 肠道黏膜保护剂

正确答案：C。止泻剂

解析：患儿，偶有发热、腹痛，主要表现为呕吐、腹泻，应诊断为由感染引发的腹泻，小儿腹泻避免用止泻剂，因为它抑制胃肠动力的作用，增加细菌繁殖和毒素的吸收，对于感染性腹泻有时是很危险的（C错，为本题正确答案）。长时间腹泻的患儿易脱水，所以应及时的采取液体疗法（A对）。急性腹泻患儿容易缺乏微量元素锌，故要应用锌制剂（B对）。肠道微生态疗法（D对）：有助于恢复肠道正常菌群的生态平衡，抑制病原菌定植和侵袭，控制腹泻。肠黏膜保护剂（E对）：能吸附病原体和毒素，维持肠细胞的吸收和分泌功能，与肠道黏液糖蛋白相互作用，可增强其屏障功能，阻止病原微生物的攻击。